同一药物制成的口服制剂，药物吸收速度最快的是
A. 散剂
B. 片剂
C. 胶囊
D. 溶液
E. 混悬剂

正确答案：D。溶液

解析：本题考查的是不同剂型的药物口服吸收情况。同一药物制成的口服制剂，药物吸收速度最快的是溶液（D对）。剂型不同，其给药途径也不相同。通常不同给药途径的药物吸收显效快慢的顺序为：静脉＞吸入＞肌内＞皮下＞舌下或直肠＞口服＞皮肤；口服制剂药物吸收速度快慢的顺序是：溶液剂＞混悬剂（E错）＞胶囊剂（C错）＞片剂（B错）＞包衣片。